M药厂销售代表在和某医院几名医师达成协议后，医师在处方时使用M药厂生产的药品，并按使用量的多少收受了药厂给予的提成。事情曝光以后，对M药厂按《药品管理法》的有关规定处理；对于医师的错误行为，有权决定给予处分没收违法所得的部门是
A. 药品监督管理部门
B. 工商行政管理部门
C. 医师协会
D. 消费者权益保护协会
E. 卫生行政部门

正确答案：E。卫生行政部门

解析：该医院几名医师在处方时使用M药厂生产的药品，并收受了药厂给予的提成，按照《药品管理法》第九十一条规定，医疗机构的负责人、药品采购人员、医师等有关人员收受药品生产企业、药品经营企业或者其代理人给予的财务或者其他利益的，应由卫生行政部门（E对）或者本单位给予医师处分，没收违法所得；对违法行为情节严重的执业医师，由卫生行政部门吊销其执业证书；构成犯罪的，依法追究刑事责任。